《麻醉药品、第一类精神药品购用印鉴卡》的审批部门是
A. 所在地省、自治区、直辖市卫生行政部门
B. 所在地省、自治区、直辖市药品监督管理部门
C. 所在地设区的市级卫生行政部门
D. 所在地设区的市级药品监督管理部门

正确答案：C。所在地设区的市级卫生行政部门

解析：本题考查麻醉药品和精神药品的使用审批。《麻醉药品、第一类精神药品购用印鉴卡》的审批部门是所在地设区的市级卫生行政部门（C对）。麻醉药品和精神药品的使用审批：1.药品生产企业需要以麻醉药品和第一类精神药品为原料生产普通药品的，应当向所在地省级药品监督管理部门（B错）报送年度需求计划，由省级药品监督管理部门汇总报国务院药品监督管理部门批准后，向定点生产企业购买。2.药品生产企业需要以第二类精神药品为原料生产普通药品的，应当将年度需求计划报所在地省级药品监督管理部门，并向定点批发企业或者定点生产企业购买。3.食品、食品添加剂、化妆品、油漆等非药品生产企业需要使用咖啡因作为原料的，应当经所在地省级药品监督管理部门批准，向定点批发企业或者定点生产企业购买。4.科学研究、教学单位需要使用麻醉药品和精神药品开展实验、教学活动的，应当经所在地省级药品监督管理部门批准，向定点批发企业或者定点生产企业购买。5.医疗机构需要使用麻醉药品和第一类精神药品的，应当经所在地设区的市级卫生健康主管部门批准，取得《麻醉药品、第一类精神药品购用印鉴卡》（以下简称《印鉴卡》）。医疗机构应当凭《印鉴卡》向本省、自治区、直辖市行政区域内的定点批发企业购买麻醉药品和第一类精神药品。6.设区的市级卫生健康主管部门发给医疗机构《印鉴卡》时，应当将取得《印鉴卡》的医疗机构情况抄送所在地设区的市级药品监督管理部门（D错），并报省级卫生主管部门（A错）备案。省级卫生主管部门应当将取得《印鉴卡》的医疗机构名单向本行政区域内的定点批发企业通报。